抑制结核菌DNA与细胞壁合成的抗结核药物是
A. 异烟肼
B. 利福平
C. 吡嗪酰胺
D. 乙胺丁醇
E. 链霉素

正确答案：A。异烟肼

解析：异烟肼（A对）通过抑制结核菌DNA与细胞壁合成及引起结核杆菌代谢紊乱起到杀菌作用。利福平（B错）通过阻碍结核杆菌mRNA合成起到杀菌作用。吡嗪酰胺（C错）通过渗透入吞噬细胞可进入结核杆菌体内，菌体内的酰胺酶脱去其酰胺基，转化为吡嗪酸而发挥抗菌作用。乙胺丁醇（D错）主要为抑菌作用，通过干扰细菌RNA合成起作用。链霉素（E错）主要通过影响蛋白质合成起作用。